肺结核的临床表现有
A. 干咳
B. 咯血
C. 乏力
D. 大量脓臭痰
E. 午后低热，盗汗

正确答案：A、B、C、E。干咳；咯血；乏力；午后低热，盗汗

解析：本题考查肺结核的临床表现。肺结核的临床表现有干咳（A对）、咯血（B对）、乏力（C对）、午后低热，盗汗（E对）。典型肺结核起病缓慢，病程较长，其临床表现为：（1）全身症状：表现为午后低热、乏力、食欲减退、消瘦、盗汗等，也称结核中毒症状。妇女可有月经失调或闭经。若肺部病灶进展播散，常呈不规则高热。检查有轻度贫血、血小板增高、血沉增快、球蛋白增高等炎性指标出现。（2）呼吸系统症状：咳嗽、咳痰、咯血、胸痛、呼吸困难。但多数患者肺结核会带有少量黏液痰，继发感染时，痰呈黏液脓性，而非大量脓臭痰（D错）。